患者，男，71岁，因“慢性咳嗽、咯痰20余年，活动后气短1年”就诊。曾确诊为COPD。近1年平地走200～300米即感到气短，近期无发热，痰液量和外观无明显变化，但常有心悸、手抖，并且口中有苦涩的金属味道。目前应用茶碱缓释片口服，沙丁胺醇气雾剂吸入，异丙托溴胺气雾剂吸入。患者有长期吸烟史，无其他慢性病。关于该患者用药教育的说法，错误的是
A. 茶碱是COPD的首选治疗药物，安全性良好
B. 短效支气管舒张剂用于缓解急性发作症状
C. 沙丁胺醇过量时可能引起骨骼肌震颤
D. 沙丁胺醇可能引起心动过速
E. 异丙托溴胺可能与口中的金属味道相关

正确答案：A。茶碱是COPD的首选治疗药物，安全性良好

解析：本题考查COPD治疗。黄嘌呤衍生物的确切作用尚存争议，茶碱是最常用的甲基黄嘌呤类药物。茶碱类药物的安全性不高，不良反应呈剂量相关性，并且治疗窗很窄（A错，为本题正确答案），多数治疗益处出现在接近中毒剂量的情况下。支气管舒张剂可松弛支气管平滑肌、舒张支气管、缓解气流受限，是控制COPD症状的主要治疗措施。短效支气管舒张剂用于缓解急性发作症状（B对）。沙丁胺醇为β₂受体激动剂，可能导致窦性心动过速（D对），有诱发易感人群出现心律失常的潜在可能。部分使用高剂量沙丁胺醇的老年患者，不论给药途径如何，可引发骨骼肌震颤（C对）。吸入性抗胆碱药物吸收很少，所以其类似阿托品的全身性不良反应较少。主要不良反应是口干，一部分使用异丙托溴氨的患者报告有苦涩的金属味道（E对）。